下列哪些不是常用的戒烟治疗中常用的戒烟药物
A. 尼古丁贴片
B. 安非他命
C. 尼古丁吸入剂
D. 盐酸安非他酮
E. 伐尼克兰

正确答案：B。安非他命

解析：在戒烟治疗的过程中，尼古丁替代疗法类药物、盐酸安非他酮和伐尼克兰是常用的戒烟药物。掌握“干预基本模式及烟草行为干预”知识点。